煅龙骨长于
A. 平肝潜阳
B. 聪耳明目
C. 收敛固涩
D. 镇惊安神
E. 息风止痉

正确答案：C。收敛固涩